下面哪项是错误的
A. 化学毒物的蓄积作用，是慢性中毒的基础
B. 物质蓄积可能引起慢性中毒的急性发作
C. 有效得排除体内毒物，防止或减少毒物的蓄积作用是预防和减少慢性中毒的重要措施
D. 在体内检查出化学毒物时，机体才可能出现相应的机能改变并表现出中毒病理现象

正确答案：D。在体内检查出化学毒物时，机体才可能出现相应的机能改变并表现出中毒病理现象

解析：本题考查化学毒物的蓄积作用。当外源化学物连续地、反复地进入机体，而且吸收速度（或总
量）超过代谢转化排出的速度（或总量）时，化学毒物或其代谢物在机体内逐渐增加和蓄积，这种现象为化学毒物的蓄积作用。化学毒物的蓄积作用，是慢性中毒的基础（A对）。物质蓄积可能引起慢性中毒的急性发作（B对）。有效得排除体内毒物，防止或减少毒物的蓄积作用是预防和减少慢性中毒的重要措施（C对）。在体内不能检查出化学毒物时，机体也可能出现相应的机能改变并表现出中毒病理现象（D错，为本题正确答案）。